抢救急危患者病历书写严禁
A. 隐匿
B. 伪造
C. 销毁
D. 涂改
E. 以上说法均正确

正确答案：E。以上说法均正确

解析：医疗机构应当按照国务院卫生行政部门规定的要求，书写并妥善保管病历资料。因抢救急危患者，未能及时书写病历的，有关医务人员应当在抢救结束后6个小时内据实补记，并加以注明。严禁涂改、伪造、隐匿、销毁或者抢夺病历资料。掌握“医疗事故处理概述、预防与处置”知识点。